提示肾小管病变严重、预后不良的尿液检查结果是
A. 透明管型
B. 颗粒管型
C. 白细胞管型
D. 脂肪管型
E. 蜡样管型

正确答案：E。蜡样管型

解析：提示肾小管病变严重、预后不良的尿液检查结果是蜡样管型（E对），其由颗粒管型、细胞管型在肾小管中长期停留变性，或直接由淀粉样变性的上皮细胞溶解后形成，质地较厚，呈浅黄色蜡状。透明管型（P315）（A错）病理条件下见于肾病综合征、慢性肾炎、恶性高血压和心力衰竭等。颗粒管型（P316）（B错）见于慢性肾炎、急性肾小球肾炎后期等。白细胞管型（P316）（C错）主要见于肾盂肾炎、间质性肾炎等。脂肪管型（P316）（D错）主要见于肾病综合征。蜡样管型（P316）（E错）多提示有严重的肾小管变性坏死，预后不良。